下列关于植牙术的论述中，不正确的是
A. 植牙术包括牙再植、牙移植和牙种植
B. 牙移植有自体移植和异体移植
C. 牙种植术是将人工材料制作的牙根种植在牙槽内的手术
D. 因正畸需要拔除的前磨牙，不可用于移植
E. 牙再植术可分为即刻再植与延期再植

正确答案：D。因正畸需要拔除的前磨牙，不可用于移植

解析：植牙术是恢复咀嚼、语音功能与面容的有效方法，包括牙再植、牙移植和牙种植三类。牙再植术，又分为即刻再植与延期再植；牙移植有自体移植和异体移植；牙种植术是指将人工材料制作的牙根种植在牙槽内的手术。因正畸需要拔除的前磨牙，也可用于移植。阻生尖牙及上颌第三磨牙的移植适应证很少。掌握“牙槽外科”知识点。